给予甲巯咪唑片10mg，一日3次，盐酸普萘洛尔片10mg，一日3次。患者1月后复查，FT₃和FT₄恢复正常，但出现膝关节疼痛。该患者出现膝关节疼痛，原因可能是
A. 甲巯咪唑致关节痛的不良反应
B. 甲亢高代谢状态致血钾水平降低
C. 甲亢高代谢状态使血钙水平降低
D. 普萘洛尔致关节痛的不良反应
E. 甲亢纠正后的正常反应

正确答案：A。甲巯咪唑致关节痛的不良反应

解析：本题考查抗甲状腺药的不良反应。该患者出现膝关节疼痛，原因可能是甲巯咪唑致关节痛的不良反应（A对）。甲巯咪唑常见不良反应为皮疹或皮肤瘙痒及白细胞减少。少见严重的粒细胞缺乏症；可能出现再生障碍性贫血；致味觉减退、恶心、呕吐、上腹部不适、关节痛、头晕头痛、脉管炎、红斑狼疮样综合征。普萘洛尔不引起关节痛的不良反应（D错）。